含有双磺酰胺结构的药物是
A. 桂利嗪
B. 氢氯噻嗪
C. 呋塞米
D. 依他尼酸
E. 螺内酯

正确答案：B。氢氯噻嗪

解析：本题考查药物结构特点。含有双磺酰胺结构的药物是氢氯噻嗪（B对）。氢氯噻嗪属苯并噻嗪类利尿药，为协同转运抑制剂，其结构中引入了两个磺酰胺基，利尿作用加强，类似的还有甲氯噻嗪、苄氟噻嗪等。桂利嗪（A错）为三苯基哌嗪类非选择性的钙离子拮抗剂。呋塞米（C错）属于含磺酰胺结构的利尿药，为Na⁺-K⁺-2Cl⁻协同转运抑制剂，类似的还有布美他尼、托拉塞米等。依他尼酸（D错）为苯氧乙酸类强利尿药，作用强且迅速，但对肝脏有损伤作用。螺内酯（E错）含有甾体结构，是盐皮质激素受体阻断药，具有保钾利尿的作用。